对全身各脏腑起温煦生化作用的是
A. 卫阳
B. 肺气
C. 心阳
D. 胃气
E. 肾阳

正确答案：E。肾阳

解析：肾阳为脏腑阳气之本，推动和激发脏腑的各种功能，温煦全身脏腑形体官窍。肾阳充盛，脏腑形体官窍得以温煦，各种功能旺盛，精神振奋。若肾阳虚衰，推动、温煦等作用减退，则脏腑功能减退，精神不振，发为虚寒性病证（E对）。卫气又称“卫阳”，卫气有防御外邪、温养全身和调节腠理的生理功能（A错）。脏腑之气是全身之气的组成部分。一身之气分布到某一脏腑，即成为某一脏腑之气。脏腑之气分为脏气、腑气；脏气又可进一步分为心气、肺气、脾气、肝气、肾气等。脏腑之气推动和激发脏腑的生理活动，某一脏腑的生理功能即某一脏腑之气的运动的具体体现。肺气的宣发与肃降运动协调，维持着肺司呼吸，主行水等功能（B错）。心位于胸中，在五行属火，为阳中之太阳，称为“阳脏”或“火脏”。心以阳气为用，心阳有推动心脏搏动，温通全身血脉，兴奋精神，以使生机不息的作用。（C错）胃气的主要生理功能是主受纳和腐熟水谷（D错）。